位于肘窝前方皮下的浅静脉是
A. 头静脉
B. 贵要静脉
C. 肘正中静脉
D. 前臂正中静脉
E. 无

正确答案：C。肘正中静脉

解析：肘正中静脉（C对）为位于肘窝前方皮下的浅静脉，通常在肘窝处连接头静脉和贵要静脉。